可用于预防长期应用广谱抗菌药继发的维生素K缺乏症的药物是
A. 维生素B
B. 维生素C
C. 维生素K
D. 维生素PP
E. 维生素E

正确答案：C。维生素K

解析：维生素K主要用于凝血酶原过低而引起的出血者，亦可用于预防长期应用广谱抗菌药继发的维生素K缺乏症。掌握“维生素K、抗贫血药和右旋糖酐”知识点。